急性牙髓炎的疼痛性质中，下面哪一点最具诊断特点
A. 热刺激痛
B. 痛向颌面部放散
C. 冷刺激痛
D. 自发性痛阵发性发作或冷热刺激加重
E. 持续性痛

正确答案：D。自发性痛阵发性发作或冷热刺激加重

解析：本题考查急性牙髓炎的临床表现。急性牙髓炎在未受到任何刺激情况下，突然发生剧烈的自发性尖锐疼痛，可有持续过程和缓解过程（E错）。为自发性痛阵发性发作或冷热刺激加重（D对），如果牙髓有化脓为热痛冷缓解（AC错）。疼痛发作时，患者不能明确指出患牙所在，且疼痛呈放射性或牵涉性、常沿三叉神经第二支或第三支分布的区域放射至患牙同侧的上下颌牙，不会放散到患牙对侧的区域（B错）。